莨菪类药物结构与中枢作用的关系是
A. 6，7位环氧使中枢作用增加
B. 6，7位无取代使中枢作用减弱
C. 羟基取代使中枢作用更弱
D. α位有羟基亦可降低中枢作用
E. 山莨菪碱的中枢作用最低

正确答案：A、B、C、D、E。6，7位环氧使中枢作用增加；6，7位无取代使中枢作用减弱；羟基取代使中枢作用更弱；α位有羟基亦可降低中枢作用；山莨菪碱的中枢作用最低